基牙预备时，为减小对牙髓的损害，可以采取下列哪种方法
A. 水雾冷却
B. 间歇切割
C. 短时切割
D. 轻压磨切
E. 以上都对

正确答案：E。以上都对

解析：本题考查保护牙髓的方法。基牙预备时应注意保护软硬组织健康，为减小对牙髓的损害，高速手机预备牙体时，必须喷水冷却（A对）。除此之外，切割牙体组织时还应注意间歇切割（B对）和短时切割（C对），这样也可以避免预备过程中产热过多。高速车针预备时对牙切割面轻压磨除（D对）既能防止温度的升高，又能有效地磨除牙体组织（ABCD均对，故E为本题的正确答案）。